四肢开放性损伤合并大血管损伤用止血带时，单次阻断血流时间不得超过
A. 30min
B. 60min
C. 90min
D. 120min
E. 15min

正确答案：B。60min

解析：四肢伤大出血应用止血带时，应每隔1小时放松1～2分钟，且使用时间一般不应超过4小时。掌握“创伤和战伤”知识点。